是阿糖腺苷的衍生物，被淋巴细胞吸收磷酸化成为有活性的是
A. 氟达拉滨
B. 卡莫司汀
C. 顺铂
D. 环磷酰胺
E. 培美曲塞

正确答案：A。氟达拉滨

解析：本题考查抗恶性肿瘤药。氟达拉滨（A对）为抗病毒药阿糖腺苷的氟化核苷酸类似物，被淋巴细胞吸收磷酸化成为有活性的药物。